位于郊区的某一居民区，在其常年主导风向的上风侧建了一个垃圾焚烧厂。鉴于本地众多居民的投诉，因而对该厂进行环境流行病学调查。下列对城市规划的描述，错误的是
A. 垃圾焚烧厂应不设在郊区
B. 垃圾焚烧厂应设在居民区常年主导风向的下风侧
C. 工业用地与生活居住用地之间应保持适当距离
D. 居住用地应选择城市中卫生条件最好的地段
E. 污染严重的工业用地与居住区间应配置绿化防护带

正确答案：A。垃圾焚烧厂应不设在郊区

解析：本题考查城市功能分区。垃圾焚烧厂应设在居民区常年主导风向的下风侧（B对），一般均设在郊区（A错，为本题正确答案）。居住用地应选择城市中卫生条件最好的地段（D对）。工业用地与生活居住用地之间应保持适当距离（C对），污染严重的工业用地与居住区间应配置绿化防护带（E对）。